以下关于牙挺的叙述中，正确的一项是
A. 用于牙钳不奏效时使用
B. 拔残根时不宜使用牙挺
C. 可代替牙钳且更加有效
D. 可代替骨凿用于增隙
E. 保护不当，易造成邻近组织损伤

正确答案：E。保护不当，易造成邻近组织损伤

解析：牙挺使用时，如保护不当，易造成邻近组织损伤，必须以手指保护，以防牙挺滑脱。掌握“牙拔除术前准备、器械、心血管及拔牙愈合过程”知识点。